血虚生风的临床症状是
A. 眩晕欲仆，肢麻震颤
B. 高热，抽搐
C. 筋挛肉啁，手足蠕动
D. 肢体麻木，筋肉跳动
E. 皮肤干燥，肌肤甲错

正确答案：D。肢体麻木，筋肉跳动

解析：血虚不能养筋，筋脉挛急，故见筋肉跳动；肝血亏少，筋脉失养，故见肢体麻木；所以血虚生风的症状有肢体麻木，筋肉跳动（D对）。肝阳化风是以眩晕、肢麻震颤（A错）、㖞僻不遂为主要表现的证。热极生风是以高热、抽搐（B错）与实热症状为主要表现的证。阴虚动风是以筋挛肉瞤，手足蠕动（C错）及虚热症状为主要表现的证。血虚证是以皮肤干燥，肌肤甲错（E错）为主要表现的证。